某童，经常睡梦中哭醒，醒后恐惧、大汗。心理咨询人员经询问梦境，每次均为狗迫咬恐惧所致。进一步询问其母，该儿在3岁时曾被狗咬。这种咨询的指导思想属于
A. 精神分析理论
B. 认知理论
C. 人本主义理论
D. 心理生理理论
E. 行为理论

正确答案：A。精神分析理论

解析：由精神分析理论（A对）指导的疗法主要包括自由联想，阻抗，和梦的分析。题中治疗师通过分析患者的梦的内容，找到了患者内心深处的潜意识下对童年被狗咬的恐惧，符合精神分析的指导思想。认知理论（B错）强调人的主观认识决定人的情绪，学习和行为，主要有理性情绪疗法和认知疗法。人本主义理论（C错）强调以人为本，向患者提供自我发现的环境，帮助患者正视自己的情绪和问题。心理生理理论（D错）认为脑和躯体的生理状况改变引起心理行为的改变。行为理论（E错）认为各种身心疾病都是通过错误学习获得的条件反射，其指导疗法有系统脱敏疗法，厌恶疗法和冲击疗法等。